冠心病心绞痛与心肌梗死的疼痛，其主要鉴别点是
A. 疼痛的持续时间与强度不同
B. 疼痛部位不同
C. 疼痛性质不同
D. 疼痛的放射部位不同
E. 疼痛时伴发恶心

正确答案：A。疼痛的持续时间与强度不同